药用部位为种仁的药材是
A. 槟榔
B. 龙眼肉
C. 肉豆蔻
D. 莲子心
E. 牛蒡子

正确答案：C。肉豆蔻

解析：本题考查的是种子类中药的药用部位。药用部位为种仁的药材是肉豆蔻（C对）。药用部位为种子、种子的一部分或种子的加工品，这类中药称为种子类中药。种子类中药的药用部位大多是完整的成熟种子，包括种皮和种仁两部分；种仁又包括胚乳和胚。也有少数用种子的一部分，如绿豆衣为种皮，肉豆蔻衣、龙眼肉（B错）为假种皮，肉豆蔻为除去种皮的种仁，莲子心（D错）为幼叶及胚根。极少数为成熟种子的加工品，如大豆黄卷为发芽种子（经发芽干燥的加工品），淡豆豉为发酵加工品。槟榔（A错）：【来源】为棕榈科植物槟榔的干燥成熟种子。牛蒡子（E错）：【来源】为菊科植物牛蒡的干燥成熟果实。